影响口服缓释制剂设计的生物因素有：
A. 药物剂量的大小
B. 药物体内半衰期
C. 药物体内吸收代谢
D. 药物油水分配系数
E. 药物溶解度

正确答案：B、C、D。药物体内半衰期；药物体内吸收代谢；药物油水分配系数

解析：本题考查影响口服缓释制剂设计的生物因素。影响口服缓释制剂设计的生物因素包括生物半衰期（B对）、吸收、代谢（C对）及油水分配系数（D对）。药物剂量及溶解度是药物的理化因素。